为提高诊断试验的灵敏度，对几个独立试验可
A. 串联使用
B. 并联使用
C. 先串联后并联
D. 要求每个试验假阳性率低
E. 要求每个试验特异度高

正确答案：B。并联使用

解析：本题考查并联试验。并联试验也称平行试验，即全部筛检试验同时平行开展，任何一项筛检试验结果阳性就可判定为阳性。为提高诊断试验的灵敏度，对几个独立试验可并联使用（B对ACDE错）。